下列食物加工过程中可应用亚硫酸盐的是
A. 熏鱼
B. 叉烧肉
C. 蜜饯
D. 火腿
E. 奶粉

正确答案：C。蜜饯

解析：亚硫酸盐不适用于鱼，肉等动物性食品，以免其残留的气味掩盖了鱼，肉的腐败气味并破坏了其中的维生素B1